可用作膜剂增塑剂的是
A. PVA17-88
B. 甘油
C. 碳酸钙
D. 聚乙二醇
E. 甘油明胶

正确答案：B。甘油